导致化妆品性酒渣鼻的主要原因是
A. 化妆品对皮肤内螨虫增殖的刺激
B. 化妆品对皮肤的直接刺激
C. 化妆品诱发螨虫在皮肤的寄生
D. 化妆品引起的皮脂腺分泌过剩
E. 化妆品引起的皮肤内螨虫毒素排出受阻

正确答案：E。化妆品引起的皮肤内螨虫毒素排出受阻